由牙尖交错位保持牙接触向后下退可达到后退接触位，两种并不在同一位置，所占有人数的比例约为
A. 0.5
B. 0.6
C. 0.7
D. 0.8
E. 0.9

正确答案：E。0.9

解析：牙尖交错位与后退接触位协调关系有两种情况：一是两者为同一位置，约有10%的人从牙尖交错位不能向后退，后退接触位与牙尖交错位为同一位。二是由牙尖交错位保持牙接触向后下退达到后退接触位；或者确定正中关系（牙合）（后退接触位）后能自如地直向前滑动到牙尖交错位（如有偏斜不超过0.5mm），其滑动距离多在0.5～1.0mm，这一距离称为长正中。人群中两位者约占90%。协调关系属生理性关系。掌握“下颌姿势位、三类颌位与前伸、侧方（牙合）颌位”知识点。